既凉血活血，又退虚热的药是
A. 赤芍
B. 紫草
C. 红花
D. 牡丹皮
E. 马齿苋

正确答案：D。牡丹皮

解析：本题考查的是牡丹皮的功效。既凉血活血，又退虚热的药是牡丹皮（D对）。牡丹皮：【功效】清热凉血，活血散瘀，退虚热。赤芍（A错）：【功效】清热凉血，散瘀止痛，清肝火。紫草（B错）：【功效】凉血活血，解毒透疹。红花（C错）：【功效】活血通经，祛瘀止痛。马齿苋（E错）：【功效】清热解毒，凉血止血，通淋。